下列有关局部振动病论述错误的是
A. 以末梢循环障碍为主
B. 还可累及肢体神经及运动功能
C. 典型表现为发作性手指变白
D. 多从手指近端开始
E. 冷水复温实验阳性

正确答案：D。多从手指近端开始

解析：本题考查局部振动病。手传振动可以引起外周循环功能改变，外周血管发生痉挛，表现为皮肤温度降低，冷水负荷试验时皮温恢复时间延长（E对），出现手传振动主要危害手臂振动病的典型临床表现发作性手指变白（C对）。振幅大，冲击力强的振动，往往引起骨、关节的损害，主要改变在上肢，亦可见手部肌肉萎缩、掌挛缩病等。长期接触较强的手传振动，可以引起外周和中枢神经系统的功能改变（B对）。手臂振动病是长期从事手传振动作业而引起的以手部未梢循环障碍（A对）、手臂神经功能障碍为主的疾病，并可引起手、臂骨关节、肌肉的损伤。白指常见的部位是示指、中指和无名指的远端指节（D错，为本题正确答案），严重者可累及近端指节，以至全手指变白。